普萘洛尔阻断突触前膜上的β受体，可引起
A. 去甲肾上腺素释放减少
B. 去甲肾上腺素释放增加
C. 去甲肾上腺素释放无变化
D. 心率增加
E. 外周血管收缩

正确答案：A。去甲肾上腺素释放减少